取皮肤癣症皮屑处理后镜下鉴别真菌主要观察的是
A. 芽胞
B. 菌丝与孢子
C. 假菌丝
D. 荚膜
E. 细胞壁结构

正确答案：B。菌丝与孢子

解析：浅部感染可取病变部位的鳞屑、病发或甲屑。如镜下直接见到孢子或菌丝可初步诊断为癣菌病。掌握“真菌概述及主要病原性真菌”知识点。